男，37岁。纳差乏力5个月，HBsAg（+），确诊为急性乙型肝炎，乙肝病毒是
A. RNA病毒
B. DNA病毒
C. EB病毒
D. 巨细胞病毒
E. 肠道病毒

正确答案：B。DNA病毒

解析：本题考查乙型肝炎病毒。男，37岁。纳差乏力5个月，HBsAg（+），确诊为急性乙型肝炎，乙肝病毒是DNA病毒（B对）。RNA病毒（A错）为遗传物质为RNA的病毒，可见于甲型肝炎病毒、丙型肝炎病毒等。EB病毒（C错）是一种人疱疹病毒，感染可表现为传染性单核细胞增多证。巨细胞病毒（D错）是以人类为唯一宿主，可导致人类疾病，是引起先天性畸形的最常见病原体。肠道病毒（E错）是指经消化道感染和传播、能在肠道中复制并引起人类相关疾病的胃肠道感染病毒，主要包括脊髓灰质炎病毒、科萨奇病毒、人肠道致细胞病变孤儿病毒及新型肠道病毒。